属于激素冲击治疗的适应证是
A. 新月体肾炎
B. 毛细血管内增生性肾小球肾炎
C. 系膜增生性肾小球肾炎
D. 局灶节段性肾小球硬化
E. 急性间质性肾炎

正确答案：A。新月体肾炎

解析：激素冲击治疗是采用短期内，大剂量激素静脉给药治疗，主要适用Ⅱ、Ⅲ型急进性肾炎，新月体肾炎是急进性肾小球肾炎的病理类型，所以属于激素冲击治疗的适应症是新月体肾炎（A对）。毛细血管内增生性肾小球肾炎（B错）表现为急性肾炎，急性肾炎治疗以休息和对症治疗为主，本病为自限性疾病，不宜使用激素及细胞毒药物治疗（P467）。系膜增生性肾小球肾炎（C错）、局灶节段性肾小球硬化（D错）常表现为肾病综合征，治疗方案为：糖皮质激素起始足量、缓慢减药、长期维持。急性间质性肾炎（E错）若采取免疫抑制治疗时，糖皮质激素治疗剂量、时间的基本方案为：泼尼松每日30～40mg，病情好转后逐渐减量，共服用2～3个月（P488）。